实验设计应遵循的基本原则是
A. 随机化、对照、盲法
B. 随机化、盲法、配对
C. 随机化、重复、配对
D. 随机化、齐同、均衡
E. 随机化、对照、重复

正确答案：E。随机化、对照、重复